理想充填材料的要求，哪一项是不正确的
A. 对人体无毒，长期在口腔中无害
B. 对牙髓无刺激性
C. 化学性能稳定
D. 机械强度越大越好
E. 具有半透明性的白色材料

正确答案：D。机械强度越大越好

解析：本题考查理想充填材料的要求。理想的充填材料应该具有足够的机械强度、稳定的化学性能、与牙体组织相近的物理性能，如热膨胀系数、导电性、导热性、色泽与牙齿接近、生物安全、方便操作等特点。机械强度并非越大越好（D错，为本题的正确答案），而是要尽量接近牙本质或牙釉质的硬度，硬度过小，则充填体以破裂；若硬度过大，则会造成对颌牙磨损。理想充填材料要对人体无毒，长期在口腔中无害（A对），即有良好的生物安全性。理想充填材料要对牙髓无刺激性（B对），符合牙治疗时尽量保护牙髓的原则。充填材料化学性能稳定（C对），保证材料经久耐用，不易变色，不易老化，不易腐蚀。使用半透明性的白色（E对）使充填后，充填物的颜色更接近牙的颜色，利于美观。